血管
A. 动、静脉间不能直接连通
B. 动脉分为深动脉、浅动脉两组
C. 肺动脉内含静脉血
D. 门静脉内合营养丰富的动脉血
E. 静脉比同级的动脉管径小

正确答案：C。肺动脉内含静脉血

解析：小动脉和小静脉之间可借血管支直接相连（A错）。肺动脉内含静脉血（C对）。静脉比同级的动脉管径粗（E错）。